用于深部真菌感染的治疗药物有
A. 两性霉素B
B. 特比萘芬
C. 氟康唑
D. 咪康唑
E. 伊曲康唑

正确答案：A、C、D、E。两性霉素B；氟康唑；咪康唑；伊曲康唑